主入脾、肾经、心经，长于暖脾胃，回阳救逆的饮片是
A. 煨姜
B. 炮姜
C. 姜炭
D. 生姜
E. 干姜

正确答案：E。干姜

解析：本题考查炮制对归经的影响。药物炮制前后归经有所改变。同一药物经不同方法炮制，归经亦发生改变，所谓生熟异用。如干姜（E对）主归脾、胃经，则以暖脾胃，回阳救逆为主；煨姜（A错）主入胃经，以和中止呕为主；生姜（D错）主归肺、胃经，以发散风寒，和中止呕为主；姜炭（C错）主入血分，以温经止血为主。